粪便显微镜检查出现巨噬细胞的疾病是
A. 急性胃肠炎
B. 阿米巴痢疾
C. 直肠癌
D. 溃疡性结肠炎
E. 直肠息肉

正确答案：D。溃疡性结肠炎

解析：巨噬细胞常见于细菌性痢疾、急性出血性坏死肠炎疾病，但溃疡性结肠炎时偶尔也可检测出（D对）。急性胃肠炎引起的轻型腹泻，一般状况良好，每天大便在10次以下，为黄色或黄绿色，少量黏液或白色皂块，粪质不多，有时大便呈"蛋花汤样"。急性胃肠炎也可以引起较重的腹泻，每天大便数次至数十次。大便常规检查及粪便培养；血白细胞计数可正常或异常（A错）。典型的阿米巴痢疾粪便为酱红色黏液样，有特殊的腥臭味。镜检可见黏液中含较多粘集成团的红细胞和较少的白细胞，有时可见夏科-雷登氏结晶和活动的滋养体（B错）。直肠癌因直肠狭窄，其粪便呈扁带状或细条状（C错）。直肠息肉多见鲜血便（E错）。